关于临床试验的对照组，下列哪项是正确的
A. 为患病的病人组成，但处理因素与试验组不同
B. 由人群中的非病例组成
C. 与病人同时入院的非某病的病例
D. 患某病的较轻型病例
E. 对照组的设立是为了防止抽样误差

正确答案：A。为患病的病人组成，但处理因素与试验组不同

解析：本题考查临床试验的对照。临床试验的对照组和实验组一样，均为患病的病人。两者的不同之处在于对照组和实验组的处理因素不同（A对BCDE错），其它基线信息尽可能保持一致，增加可比性。